总结宋代以前的中药本草的本草书籍是
A. 《神农本草经》
B. 《证类本草》
C. 《本草经集注》
D. 《本草纲目》
E. 《本草纲目拾遗》

正确答案：B。《证类本草》

解析：本题考查的是对历代本草代表作的了解。总结宋代以前的中药本草的本草书籍是《证类本草》（B对）。《经史证类备急本草》：简称《证类本草》，为宋金元时期宋代的本草代表作。作者唐慎微。该书图文对照，方药并收，医药结合，资料翔实，集宋以前本草之大成，使大量古代文献得以保存，具有极高的学术价值和文献价值。《神农本草经》（A错）：简称《本经》，为汉代本草代表作。该书系统总结了汉代以前我国药学发展的成就，是现存最早的药学专著，为本草学的发展奠定了基础。《本草经集注》（C错）：为魏晋南北朝本草代表作。作者为陶弘景。该书第一次全面系统地整理、补充了《本经》，反映了魏晋南北朝时期的本草学成就，初步确立了综合性本草著作的编写模式。《本草纲目》（D错）：简称《纲目》，为明代本草代表作。作者李时珍。该书不仅集我国16世纪以前药学成就之大成，将本草学的发展提高到一个空前的高度，而且在生物、化学、天文、地理、地质、采矿等方面也有突出的成就，对世界医药学和自然科学的许多领域做出了举世公认的卓越贡献。《本草纲目拾遗》（E错）：简称《纲目拾遗》，为清代本草代表作。作者赵学敏，定稿于1803年（清嘉庆八年）。全书共10卷，载药921种，其中新增716种，创古本草增收新药之冠，极大地丰富了本草学。同时，对《本草纲目》略而不详的加以补充，错误的加以订正，不但总结了16～18世纪本草学发展的新成就，而且还保存了大量今已散佚的方药书籍的部分内容，具有很高的实用价值和文献价值。